巴豆内服的用量是
A. 0.1〜0.3克
B. 0. 5〜1克
C. 1.5〜3克
D. 3〜5克
E. 5〜10克

正确答案：A。0.1〜0.3克

解析：巴豆有大毒可入丸散服，每次0.1-0.3g。大多数制成巴豆霜用，以减低毒性。外用适量（A对）。巴豆的药理作用，巴豆油外用，对皮肤有强烈刺激作用。口服半滴至1滴，即能产生口腔、咽及胃黏膜的烧灼感及呕吐，短时期内可有多次大量水泻，伴有剧烈腹痛和里急后重。